女，65岁。上腹痛1年。胃镜检查见胃窦2cm大小溃疡，边缘不规则，胃壁僵硬，基底部白苔，质脆，易出血，其最佳手术方法是
A. 胃窦切除术
B. 全胃切除术
C. 根治性胃大部切除术
D. 胃空肠吻合术
E. 单纯胃大部切除术

正确答案：C。根治性胃大部切除术

解析：老年女性患者，上腹痛1年，胃镜检查见胃窦一2cm大小溃疡，边缘不规则，胃壁僵硬，底部白苔、质脆，应考虑为胃癌。外科手术是胃癌的主要治疗手段，分为根治性手术和姑息性手术两类。由于该患者病变较局限，癌灶直径仅为2cm，因此最佳的手术方法是根治性胃大部切除术（C对）。胃窦切除术（A错）、单纯胃大部切除术（E错）是胃溃疡外科治疗常用的手术方式。全胃切除术（B错）可用于胃体部癌灶范围较大的患者，由于术后并发症较多，一般不用于癌灶较小的患者。胃空肠吻合术（D错）、空肠造口等为胃癌的姑息性手术，用于原发灶无法切除的患者。